患者女性，50岁，近半年来自觉心前区阵发性疼痛，常在休息或清晨时发作，持续时间一般为20分钟或半小时，含服硝酸甘油后缓解，疼痛发作时心电图胸前导联ST段抬高，其诊断为
A. 变异型心绞痛
B. 恶化型心绞痛
C. 初发型心绞痛
D. 稳定型心绞痛
E. 急性心肌梗死

正确答案：A。变异型心绞痛

解析：患者所发生的心绞痛持续20分钟或半小时，含服硝酸甘油后缓解，疼痛发作时心电图胸前导联ST段抬高，是变异型心绞痛的特点，故诊断为变异型心绞痛（A对）。恶化型心绞痛指原有稳定型心绞痛的病人，在3个月内疼痛的频率、程度、诱发因素经常变动，进行性恶化，病人的痛阈逐步下降，于是较轻的体力活动或情绪激动即能引起发作，故发作次数增加，疼痛程度较剧，发作的时限延长，可超过10分钟，用硝酸甘油后不能使疼痛立即或完全消除。发作时心电图示ST段明显压低与T波倒置，但发作后又恢复，且不出现心肌梗塞的变化（B错）。初发型心绞痛是指患者以前没有过心绞痛的发作，而是在最近的1到2个月内发生的，由于心肌缺血氧引起的心绞痛症状，表现为心前区的胸痛，胸闷，伴有心电图的缺血性改变（C错）。稳定型心绞痛是由于劳力引起心肌缺血，导致胸部及附近部位的不适，可伴心功能障碍，但没有心肌坏死。其特点为前胸阵发性的压榨性窒息样感觉，主要位于胸骨后，可放射至心前区和左上肢尺侧面，也可放射至右臂和两臂的外侧面或颈与下颌部，持续数分钟，往往经休息或舌下含服硝酸甘油后迅速消失（D错）。